儿童青少年人群发生单纯性肥胖有四个较敏感的阶段。请指出下面列举的哪个阶段不属此列
A. 孕后期
B. 婴儿期
C. 青春早期
D. 青春中期
E. 青春后期

正确答案：D。青春中期